下列不是HMG-CoA还原酶抑制药适应症的是
A. 肾病综合征
B. 肾病综合征引起的低Ch血症
C. 心脑血管急性事件的预防
D. 器官移植后的排异反应
E. 骨质疏松症

正确答案：B。肾病综合征引起的低Ch血症

解析：HMG-CoA还原酶抑制药临床上主要用于杂合子家族性和非家族性Ⅱa、Ⅱb和Ⅲ型高脂血症，也可用于2型糖尿病和肾病综合征引起的高Ch血症。亦可用于肾病综合征、血管成形术后再狭窄、心脑血管急性事件的预防及器官移植后的排异反应和骨质疏松症等。掌握“抗动脉粥样硬化药”知识点。